关于流产的描述，以下哪项正确
A. 流产的主要症状为停经后出现阴道流血和腹痛
B. 有先兆流产症状者绝对不应做阴道检查
C. 难免流产时妊娠试验均为阴性
D. 完全流产虽然胎儿完全排出，就诊时阴道流血仍多
E. 不全流产经休息及治疗，症状消失者可继续妊娠

正确答案：A。流产的主要症状为停经后出现阴道流血和腹痛